患者腹部痞胀，纳呆呕恶，肢体困重，身热起伏，汗出热不解，尿黄便溏。其舌象应是
A. 舌红苔黄腻
B. 舌红苔黄糙
C. 舌绛苔少而干
D. 舌绛苔少而润
E. 舌红苔白而干

正确答案：A。舌红苔黄腻

解析：湿热蕴脾证，是湿热内蕴中焦所表现的证候。腹部痞胀，纳呆呕恶均多因湿热阻滞中焦，纳运失健，气机阻滞所致；肢体困重多因脾主肌肉，湿性重着，脾为湿困所致；身热起伏，汗出热不解多因湿遏热伏，湿热郁蒸所致；尿黄便溏多因湿热蕴脾，交阻下迫所致；舌红苔黄腻多为湿热内蕴之征，故舌象应是舌红苔黄腻（A对）。舌红苔黄糙为舌红与苔黄糙并见，舌红多为热证；苔黄糙多为邪热伤津，燥结腑实之证（B错）。舌绛苔少而干多因阴虚火旺所致（C错）。舌绛苔少而润多因血瘀所致（D错）。舌红苔白而干，多因邪热入里伤津所致（E错）。